免疫系统不包括
A. 免疫组织
B. 免疫器官
C. 免疫细胞
D. 免疫分子
E. 免疫应答

正确答案：E。免疫应答

解析：免疫应答是免疫系统的行为，不是组成成分。